对牙周兼性厌氧菌及微需氧菌感染无效的是
A. 四环素
B. 二甲胺四环素
C. 螺旋霉素
D. 洗必泰
E. 甲硝唑

正确答案：E。甲硝唑

解析：本题考查常用的抗菌药物。对牙周兼性厌氧菌及微需氧菌感染无效的是甲硝唑（E对）。甲硝唑对兼性厌氧菌感染无效，但可与其他药物如阿莫西林、螺旋霉素或四环素等联合使用，治疗由伴放线聚集杆菌（微需氧菌）感染所致的侵袭性牙周炎和难治性牙周炎等。四环素族药物（AB错）对兼性厌氧菌及微需氧菌感染有效。螺旋霉素（C错）是用于口腔牙周病治疗的大环内酯类药物，该药对革兰阳性菌抑制力强，对革兰阴性菌也有一定的抑制作用。洗必泰（D错）是一种含漱药物，对革兰阳性菌及革兰阴性菌和真菌都有较强的抗菌作用，是目前已知效果最确切的抗菌斑药物。